男，14岁。因阵发性心悸3年，再发2小时入院。查体无异常发现。心电图：心率180次/分，节律规则，QRS波群时限0.11秒，可见逆行P波。该患者最可能的诊断为
A. 阵发性室上性心动过速
B. 阵发性室性心动过速
C. 窦性心动过速
D. 心房扑动
E. 非阵发性房室交界区心动过速

正确答案：A。阵发性室上性心动过速

解析：患者青少年男性，有心悸症状，心电图检查心率达180次/分（正常值60～100次/分，阵发性室上性心动过速的心室率一般为150～250次/分），节律规则，QRS时限正常，可见逆行性P波（阵发性室上性心动过速的典型心电图表现），该患者最可能的诊断为阵发性室上性心动过速（A对）。阵发性室性心动过速（P198）（B错）可阵发性发作，心室率通常在100～250次/分，但P波正常，无逆行P波，QRS波群形态畸形，多可见心室夺获与室性融合波。窦性心动过速（P182）（C错）通常逐渐开始和终止，频率大多在100～150次/分，P波正常。心房扑动（P187）（D错）的心电图特征为P波消失，呈现规律的锯齿状扑动波（F波）。非阵发性房室交界区心动过速（E错）发作起始终止时心率逐渐变化，与患者阵发性心悸不符。